不是由腹腔干的分支供养的脏器是
A. 肝
B. 胆囊
C. 胃
D. 脾
E. 肾上腺

正确答案：E。肾上腺

解析：肝（A对）、胆囊（B对）、胃（C对）、脾（D对）均为腹腔干的分支供养的脏器。肾上腺（E错，为本题正确答案）为腹主动脉的分支供养的脏器。